高致病性病原微生物菌（毒）种或者样本在储存中被盗或者泄漏的，保藏机构应当向主管部门报告的时限为
A. 1小时内
B. 2小时内
C. 立即
D. 3小时内
E. 4小时内

正确答案：B。2小时内